经肝脏细胞色素P450依赖性单加氧酶系代谢活化的毒物与此酶系的抑制剂联合作用，该毒物的毒性效应
A. 减弱
B. 增强
C. 无变化
D. 持续时间延长
E. 潜伏期延长

正确答案：A。减弱